患者因腹胀，全身疼痛而就诊。检查：脾肋缘下6cm，血液白细胞计数160×109/L，可见各阶段幼稚粒细胞少许。应首先考虑的是：
A. 脾功能亢进
B. 门脉性肝硬化
C. 急性粒细胞白血病
D. 慢性粒细胞白血病
E. 急性淋巴细胞白血病

正确答案：D。慢性粒细胞白血病

解析：本例患者有腹胀、全身疼痛的病史，查体可见脾大，达肋缘下6cm，血常规可见白细胞计数160×109/L（正常值4～10×109/L，严重偏高），超过100×109/L，并且可见各阶段幼稚粒细胞少许，诊断首先考虑为慢性粒细胞白血病（D对）。脾功能亢进（A错）患者的主要临床表现为脾大，一种或多种血细胞减少而骨髓造血细胞相应增生，一般不会有白细胞急剧增高的表现。门脉性肝硬化（B错）的主要临床表现为脾大，若合并感染白细胞计数可升高，但一般不会超过100×109/L。急性粒细胞白血病（C错）和急性淋巴细胞白血病（E错）也可以出现脾大，大多数患者白细胞增多，但一般不会超过100×109/L，部分患者也可表现为白细胞计数正常或减少。